缺乏某因素不会引起该病，这个因素被称为
A. 充分病因
B. 必要病因
C. 非充分病因
D. 非必要病因
E. 危险因素

正确答案：B。必要病因